血ACTH水平不升高的库欣综合征，其病因可能是
A. 垂体ACTH微腺瘤
B. 垂体ACTH细胞增生
C. 支气管类癌
D. 小细胞肺癌
E. 肾上腺皮质腺瘤

正确答案：E。肾上腺皮质腺瘤

解析：库欣综合征按照病因分类可以分为依赖ACTH的库欣综合征和不依赖ACTH的库欣综合征。不依赖ACTH的库欣综合征包括肾上腺皮质腺瘤、肾上腺皮质癌（E对）、不依赖ACTH的双侧肾上腺小结节性增生、不依赖ACTH的双侧肾上腺大结节性增生，其血浆ACTH水平多降低。依赖ACTH的库欣综合征包括Cushing病和异位ACTH综合征（P699），其血浆ACTH水平常升高。Cushing病是指垂体ACTH分泌过多，伴有肾上腺皮质增生，垂体多有微腺瘤（A错），少数为大腺瘤。垂体ACTH细胞增生（B错）时血ACTH水平亦可升高引起库欣综合征。异位ACTH综合征指垂体以外的肿瘤分泌大量ACTH引起库欣综合征，如支气管类癌（C错）、小细胞肺癌（D错）。